消毒与灭菌的方法中，能够达到灭菌的效果的是
A. 化学方法
B. 射线方法
C. 紫外线方法
D. 物理方法
E. 重金属强酸盐方法

正确答案：D。物理方法

解析：消毒与灭菌的方法一般可分为物理学方法和化学方法两大类。物理学方法多可达到灭菌效果，而化学方法多数仅达到消毒目的。掌握“消毒与灭菌”知识点。